患者情志抑郁，小便通而不畅，胁腹胀满，舌红苔薄黄，脉弦。治疗应首选
A. 补中益气汤
B. 代抵当丸
C. 八正散
D. 清肺饮
E. 沉香散

正确答案：E。沉香散

解析：患者小便通而不畅，故诊断癃闭；七情内伤，气机郁滞，肝失疏泄，水液排出受阻，故小便通而不畅，情志抑郁；肝气横逆，故胁腹胀满；舌红苔薄黄，脉弦，是肝郁化火之势，故其证候为肝郁气滞证，治以疏利气机，通利小便，代表方位沉香散，方中沉香、橘皮可疏达肝气，当归、王不留行以行下焦之气血，石苇、冬葵子、滑石能通利水道（E对）。补中益气汤，其功用为补中益气，升阳举陷，可用于癃闭之脾气不升证（A错）。代抵当丸，其功用为活血化瘀散结，可用于癃闭之浊瘀阻塞证(B错)。八正散，其功用为清热利湿，利尿通淋，可用于癃闭之膀胱湿热证（C错）。清肺饮，其功用为清肺泄热利水，可用于癃闭之肺热壅盛证（D错）。